支气管哮喘病人急性发作时，PaCO₂逐渐增高表示
A. 没有临床意义
B. 病情好转
C. 病情严重
D. 发作早期
E. 有心血管并发症

正确答案：C。病情严重

解析：在重度哮喘时，气道阻塞严重，缺氧加重并出现CO₂潴留，患者出现严重的低氧血症和高二氧化碳血症，PaCO₂上升表现为呼吸性酸中毒，因此当PaCO₂逐渐增高表示病情严重（C对B错）。PaCO₂为诊断支气管哮喘动脉血气分析的检查，可用于判断严重哮喘的病情变化（A错）。发作早期支气管哮喘发作时缺氧，PaO₂降低，由于过度通气可使PaCO₂降低，pH上升，表现为呼吸性碱中毒（D错）。PaCO₂逐渐增高提示体内CO₂潴留，与心血管并发症（E错）并无多大关系。